男，6岁。发热2周，轻咳，精神差，一直抗生素静脉治疗，仍发热。近2日诉头痛，时有呕吐，突起抽搐，经用止痉剂脱水剂好转后仍有间断抽搐，为明确诊断，首要的检查是
A. 血培养
B. 血PTH测定
C. 血钙测定
D. 脑脊液检查
E. 脑电图

正确答案：D。脑脊液检查

解析：患儿头痛，时有呕吐，提示存在颅内压升高；发热2周提示颅内病变可能为感染所致；脑脊液检查对于病因的确定有很大的帮助（D对）。其余选项血培养（A错）主要用于诊断血中的细菌感染；血PTH测定（B错）主要用于甲状旁腺功能的诊断；血钙测定（C错）用于测定血钙，诊断高钙血症或低钙血症；脑电图（E错）多用于诊断神经系统病变；以上几项对本病明确诊断意义不大。